属于孕激素的生理作用是
A. 使阴道上皮细胞脱落加快
B. 使宫颈粘液变稀薄
C. 使子宫肌层增厚
D. 使子宫内膜增生
E. 使血循环中胆固醇水平降低

正确答案：A。使阴道上皮细胞脱落加快

解析：孕激素的生理作用：使增生期子宫内膜转化为分泌期内膜，为受精卵着床作准备（D错）；使宫口闭合，黏液分泌减少，性状变黏稠（B错）；使阴道上皮细胞脱落加快（A对）。雌激素的生理作用：促进子宫肌细胞增生和肥大，使子宫肌层增厚（C错）；降低血循环中胆固醇水平（E错）。